教室自然采光的要求正确的是
A. 只要课桌面照度足够即可
B. 只要黑板照度足够即可
C. 照度分布可不均匀
D. 应避免发生较强的眩光
E. 采光窗应在右侧

正确答案：D。应避免发生较强的眩光